关于药物经皮吸收的说法，正确的是
A. 吸收的主要途径是汗腺，毛囊等皮肤附属器
B. 吸收的速率与分子量成正比
C. 分子型药物增多，不利于药物的经皮吸收
D. 低熔点的药物容易渗透通过皮肤
E. 药物与基质的亲和力越大，释放越快

正确答案：D。低熔点的药物容易渗透通过皮肤

解析：本题考查药物的经皮吸收。低熔点的药物容易渗透通过皮肤（D对）；皮肤附属器官仅占皮肤表面积的0.1%，不是吸收的主要途径（A错）；吸收的速率与分子量成反比（B错）；分子型药物有利于药物的经皮吸收（C错）；药物与基质的亲和力越大，释放越慢（E错）。